最常见的牙弓形态是
A. 尖圆形
B. 方圆形
C. 椭圆形
D. 混合型
E. 正圆形

正确答案：C。椭圆形

解析：本题考查牙弓形态。最常见的牙弓形态是椭圆形（C对）。 根据六个前牙的排列情况，牙弓的形状可概括地分为三种基本类型，即尖圆形、方圆形和椭圆形。尖圆形占26%，方圆形占24%，椭圆形占46%。另外，有部分为以上两种或者三种形态的混合型，约占4%。